临床中常用的暂时粘固剂是
A. 磷酸锌水门汀
B. 羧酸锌水门汀
C. 玻璃离子黏固剂
D. 氧化锌丁香油水门汀
E. 复合树脂粘结剂

正确答案：D。氧化锌丁香油水门汀

解析：暂时冠的粘固应使用专用的暂时粘固剂，既要保证在戴用期间不松动脱落，又要方便在正式修复体试戴前取下。常用的暂时粘固剂是氧化锌丁香油水门汀，丁香油酚对牙髓有很好的安抚作用，可避免牙本质敏感。掌握“暂时冠及印模与模型”知识点。